心脏病患者手术耐受力最差的类型是：
A. 房室传导阻滞
B. 风湿性心脏病
C. 高血压心脏病
D. 急性心肌炎
E. 冠状动脉粥样硬化型心脏病

正确答案：D。急性心肌炎

解析：参阅五版外科学（P154），心脏病与手术耐受力的关系分为三类：1、手术耐受力良好者：包括非紫绀型先心病、风湿性心脏病（B错）、高血压心脏病（C错）、心率正常无心衰趋势者；2、手术耐受力较差者：包括冠状动脉粥样硬化型心脏病（E错）、房室传导阻滞（A错）；3、手术耐受力很差者：包括急性心肌炎（D对）、急性心梗、心力衰竭。